年轻恒牙深龋进行再矿化治疗时，软化牙本质再矿化的时间大约是
A. 2～4周
B. 10～12周
C. 1～2个月
D. 4～6个月
E. 2年左右

正确答案：B。10～12周

解析：本题考查年轻恒牙深龋的再矿化治疗。近年来北美儿童口腔科对较大的深龋多采用氢氧化钙的再矿化治疗。由于氢氧化钙的pH在值在11以上，有一定的杀菌作用，可以抑制龋蚀的进展，且其刺激作用促使牙髓形成修复性牙本质。覆盖氢氧化钙10-12周（B对），窝洞底脱矿牙本质可再矿化。若覆盖时间过短，如2-4周（A错），软化牙本质未矿化或未完全矿化，去除软化牙本质时易露髓。若覆盖时间过长，如1-2个月（C错）、4-6个月（D错）和2年（E错），氢氧化钙易吸收，封闭材料脱落。因此应适时去除暂时充填物进行永久修复。